机械性记忆、思维能力发展最快的时期是
A. 婴儿期
B. 幼儿期
C. 学龄前期
D. 学龄期
E. 青春期

正确答案：D。学龄期